临床记录中，唇面以英文字母命名
A. L
B. B
C. O
D. La
E. D

正确答案：D。La

解析：窝洞的命名以英文字母命名：颊面buccal写为B：舌面lingual写为L；（牙合）面occlusal写为O；远中面distal写为D；近中面mesial写为M；唇面labial写为La；切端incisal写为I。掌握“银汞充填窝洞的概念”知识点。